直接影响筛检试验阳性预测值的是
A. 发病率
B. 患病率
C. 死亡率
D. 生存率
E. 罹患率

正确答案：B。患病率